舌杆应离开龈缘，并且要有一定的宽度。采用舌杆时口底要有足够的深度，下前牙舌侧龈缘至口底的距离要大于
A. 4mm
B. 8mm
C. 10mm
D. 15mm
E. 20mm

正确答案：B。8mm

解析：本题考查舌杆。龈缘到口底的距离要包括舌杆距龈缘的距离和舌杆本身的宽度，舌杆距龈缘3～4mm，本身宽3～4mm，所以总的距离应大于6～8mm（B对）。